对癫痫小发作最好选用
A. 乙琥胺
B. 苯妥英钠
C. 地西泮
D. 丙戊酸钠
E. 硫酸镁

正确答案：A。乙琥胺